男，24岁。在工厂流水线工作时，电锯切割致左手示指离断。对断指的正确的保持方法是用无菌纱布包好放置在
A. 干燥冷藏容器中
B. 酒精中
C. 福尔马林溶液中
D. 生理盐水中
E. 冰箱冷冻室中

正确答案：A。干燥冷藏容器中

解析：离断指断面应用清洁敷料包扎以减少污染，故先用无菌纱布包好。若受伤场地离医院较远，离断指应采用干燥冷藏法保存，即将断指清洁或无药敷料包裹，置入塑料袋中密封，再放于加盖的容器内，外周放入冰块保护（A对E错）。切忌将离断指浸泡于任何溶液中（BCD错）。到达医院后，检查断指，用无菌敷料包裹放于无菌盘中，置入4℃冰箱内（P648）。